男，38岁。发热2周，胸闷5天。无咳嗽、咳痰、咯血，曾使用“头孢曲松”抗感染治疗无效。查体：T37.8℃，BP140/90mmHg。右下肺呼吸音消失，语音共振减弱。胸部X线片示右下肺大片状高密度增高影，上缘呈外高内低弧形，为明确诊断，应选的检查是
A. 支气管镜
B. 胸腔穿刺抽液
C. 胸部CT
D. 血肿瘤标志物
E. 超声心动图

正确答案：B。胸腔穿刺抽液

解析：中年男性患者，发热2周、胸闷5天，无咳嗽、咳痰和咯血，曾使用“头孢曲松”抗感染治疗无效（提示结核感染）。查体：T37.8℃（体温正常值36℃～37.3℃，即低热，结核感染的表现），右下肺呼吸音消失，语音共振减弱，胸部X线显示右下肺大片状高密度影，上缘呈外高内低弧形（提示存在大量胸腔积液），根据其临床表现和辅助检查，考虑诊断为结核性胸腔积液。结核性胸腔积液为渗出液，为明确诊断，首选胸腔穿刺抽液（B对）。支气管镜（A错）主要用于中央型肺癌的诊断，对确定病变范围、明确手术指征与方式有帮助。胸部CT（C错）为影像学检查，可有助于病因的诊断，但不能明确诊断。血肿瘤标志物（D错）检查主要用于恶性肿瘤的辅助诊断。超声心动图（E错）主要用于心包积液、心肌病、心脏瓣膜病的辅助诊断。